患者久病，眼睑开合失司，下肢运动不利，其病在哪经
A. 阴跷脉、阳跷脉
B. 阴维脉、阳维脉
C. 督脉、任脉
D. 冲脉、任脉
E. 阴跷脉、阴维脉

正确答案：A。阴跷脉、阳跷脉

解析：该题考查奇经八脉的主要机能。跷脉主司下肢运动，司眼睑开合，阳跷阴跷有病则眼睑开合失司，下肢运动不利（A对）。